哮喘患者最不宜选用的降压药为
A. 利尿剂
B. α受体阻滞剂
C. β受体阻滞剂
D. 二氢吡啶类钙拮抗剂
E. 血管紧张素转换酶抑制剂

正确答案：C。β受体阻滞剂

解析：非选择性β肾上腺素受体阻滞药（C对）由于对支气管平滑肌β₂受体的阻断作用，可使呼吸道阻力增加，诱发或加剧哮喘，选择性β₁受体阻断药及具有内在拟交感活性的药物，一般不引起上述的不良反应，但这类药物的选择性往往是相对的，故对哮喘患者仍应慎重。利尿剂（A错）、α受体阻滞剂（B错）、二氢吡啶类钙拮抗剂（D错）、血管紧张素转换酶抑制剂（E错）均可用于哮喘的患者。